胆固醇和酮体合成的中间产物是
A. β-羟丁酸
B. β-羟脂酰CoA
C. HMG-CoA
D. 磷酸二羟丙酮
E. 琥珀酰CoA

正确答案：C。HMG-CoA